男，56岁。上腹不适，进食后饱胀2个月，时有恶心、呕吐，上腹部隐痛，无烧心、反酸，查体：T36.5℃，P80次／分，R18次／分，BP120/80mmHg。身高170cm，体重52Kg，心肺查体未见异常，上腹部轻压痛，无肌紧张、反跳痛。胃镜在胃底小弯侧见直径2.5cm溃疡，上有污秽苔，质脆易出血，其转移灶最常见的部位是
A. 骨髓
B. 胰
C. 肺
D. 肝
E. 脑

正确答案：D。肝

解析：患者上腹不适，进食后饱胀2个月，时有恶心、呕吐，上腹部隐痛，查体上腹部轻压痛。胃镜检查发现在胃底小弯侧一直径2.5cm溃疡，上有污秽苔，质脆易出血。考虑晚期胃癌。80%的早期胃癌无症状，部分病人可有消化不良症状。进展期胃癌最常见的症状是体重减轻（患者身高170cm，体重52Kg，BMI值18，属于体重过轻）和上腹痛（50%）。早期胃癌无明显体征，进展期在上腹部可扪及肿块，有压痛。胃镜检查早期胃癌可表现为小的息肉样隆起或凹陷；也可呈平坦样，但黏膜粗糙 、触之易出血，斑片状充血及糜烂。而进展期胃癌肿瘤表面常凹凸不平，糜烂，有污秽苔，活检时易出血（P365）。血行播散在晚期病人中可占60%以上。最常转移到肝脏（D对），其次是肺（C错）、腹膜、肾上腺，也可转移到肾、脑（E错）、骨髓（A错）等。